对频繁发作的短暂性脑缺血发作，应用的治疗是
A. 华法林
B. 阿司匹林
C. 噻氯匹定
D. 噻氯匹定加双嘧达莫
E. 尼莫地平

正确答案：A。华法林

解析：治疗短暂性脑缺血发作（TIA） 时，虽然抗凝药不作为常规，但对于频繁发作者，应使用华法林行抗凝治疗（A对） 。对于偶尔发作的TIA， 应行抗血小板治疗，可以单独使用阿司匹林（B错）、噻氯匹定（C错），或与双嘧达莫联合应用（D错）。故答A 而不是B很多医考参考书将答案错为B 。尼莫地平（E错）为钙通道阻滞剂，常用于高血压合并脑血管痉挛者。